为准确计算各种食物在烹调后的维生素含量，需要考虑
A. 维生素保留因子
B. 维生素保留因子、蛋白质转化系数
C. 维生素保留因子、可食部比例
D. 维生素保留因子、膨胀率
E. 维生素保留因子、重量变化因子

正确答案：E。维生素保留因子、重量变化因子

解析：本题考查计算各种食物在烹调后的维生素含量，需要考虑的因素。为准确计算各种食物在烹调后的维生素含量，需要考虑维生素保留因子和重量变化因子（E对ABCD错）。